咬肌间隙感染一般不会累及
A. 翼颌间隙
B. 颊间隙
C. 颞下间隙
D. 眶下间隙
E. 颞间隙

正确答案：D。眶下间隙

解析：本题考查咬肌间隙感染。嚼肌间隙感染一般不会累及眶下间隙（D错，为本题的正确答案）。咬肌间隙借颊脂垫、咬肌神经、血管与颊（B对）、翼下颌（A对）、颞（E对）、颞下（C对）等间隙相通。咬肌间隙感染一般不会累及眶下间隙。